其证候是
A. 肝肾不足
B. 气血虚弱
C. 肾阳虚弱
D. 脾虚
E. 阴虚血燥

正确答案：E。阴虚血燥

解析：患者2年来月经量逐渐减少，现闭经半年，是因为阴血不足，日久益甚，虚热内生，火逼水涸，血海燥涩渐涸，故月经延后，量少，逐渐闭经；五心烦热、盗汗失眠、口干欲饮是因为阴虚日久，虚火内炽，舌红少苔，脉细数为阴虚血燥之征（E对）。肝肾不足证除闭经基本证候常伴有身体发育欠佳，腰膝酸软，头晕耳鸣，倦怠乏力等肝肾亏损证候（A错）。气血虚弱证常伴有神疲肢倦，头晕眼花，心悸气短，面色萎黄等气血虚弱证候（B错）。肾阳虚弱证常伴有面色晦黯，肢冷畏寒，腰膝酸软，小便清长，夜尿多等肾阳虚证候（C错）。脾虚证闭经经色淡质清稀，并伴有面色晄白，神疲气短，或面浮肢肿，小腹空坠，四肢不温，纳少便溏等脾虚证候（D错）。